支气管扩张患者因感染反复加重多次住院，再次因感染加重行抗感染治疗时，应特别注意的病原体是
A. 肠杆菌
B. 耐甲氧西林金黄色萄萄球菌
C. 军团菌
D. 铜绿假单胞菌
E. 耐青霉素肺炎链球菌

正确答案：D。铜绿假单胞菌

解析：支气管扩张症反复发生支气管化脓性炎症，反复加重多次住院时，易并发铜绿假单胞菌（D对）感染。大肠杆菌（A错）为机会致病菌。耐甲氧西林金黄色萄萄球菌（B错）也可致支气管扩张，但不如铜绿假单胞菌多见。军团菌、耐青霉素肺炎链球菌（CE错）非支气管扩张症的致病菌。